提出小儿“肝常有余，脾常不足”，“心常有余，肺常不足”，“肾常虚”的医家是
A. 陈文中
B. 曾世荣
C. 鲁伯嗣
D. 万全
E. 陈飞霞

正确答案：D。万全

解析：明代医家万全首先提出“三有余，四不足”的小儿生理病理学说，在治疗方面首重保护胃气，其著作颇丰（D对）。南宋陈文中著《小儿痘疹方论》《小儿病源方论》，以擅用温补扶正见长，对痘疹类时行疾病因阳气虚寒而产生的逆证，用温补托毒急救（A错）。元代曾世荣其代表作为《活幼心书》，是中医新生儿学较早的集中论述，以调元散、补肾地黄丸治疗胎怯（B错）。明代鲁伯嗣著《婴童百问》，详述儿科病症病源、证候及疗法（C错）。清代陈飞霞其代表作为《幼幼集成》，指纹诊法“浮沉分表里、红紫辨寒热、淡滞定虚实”，“风轻、气重、命危”至今为临床所采用（E错）。